下列哪项胆囊结石在行X线腹部平片检查时常显影
A. 胆固醇结石
B. 胆色素结石
C. 混合性结石
D. 泥沙样结石
E. 黑结石

正确答案：C。混合性结石

解析：混合性结石（C对）由胆固醇、胆红素、钙盐等多种成分混合组成，X线腹部平片检查时常显影。胆固醇结石（A错）主要由胆固醇组成，X线检查多不显影。胆色素结石（B错）、泥沙样结石（D错）、黑结石（E错）主要由胆色素构成，X线下不易显影。